关于锥体系的描述，错误的是
A. 是管理骨骼肌随意运动的通路
B. 由上、下两级神经元组成
C. 上运动神经元的轴突均直接支配下运动神经元
D. 锥体束指的是上运动神经元
E. 以上都不是

正确答案：E。以上都不是

解析：锥体束由上运动神经元和下运动神经元两级神经元组成（B对），上运动神经元的轴突均直接支配下运动神经元（C对）。锥体束指的是上运动神经元（D对），管理骨骼肌随意运动的通路（A对，E为本题正确答案）。